属于行政处罚的是
A. 降职
B. 罚款
C. 赔偿损失
D. 恢复名誉
E. 支付违约金

正确答案：B。罚款

解析：行政处罚的种类主要有警告、罚款、没收非法财物、没收违法所得、责令停产停业、暂扣或吊销有关许可证等。掌握“卫生法的守法、执法和司法”知识点。